构成鼻中隔的结构有
A. 鼻骨．犁骨和筛骨的垂直板
B. 筛骨垂直板．犁骨及鼻中隔软骨，并被覆粘膜
C. 筛骨垂直板犁骨和腾骨的垂直部
D. 腭骨水平部和上颌骨额突
E. 无

正确答案：B。筛骨垂直板．犁骨及鼻中隔软骨，并被覆粘膜

解析：鼻中隔由筛骨垂直板、犁骨和鼻中隔软骨组成支架，表面被覆黏膜（B对）。